20世纪50年代Friedman和Rosenman等提出的冠心病易发性格模型，指的是
A. A型性格
B. B型性格
C. C型性格
D. E型性格
E. D型性格

正确答案：A。A型性格